卵巢未成熟畸胎瘤
A. 是最常见的卵巢良性肿瘤
B. 有恶性程度的逆转倾向
C. hCG升高
D. CAl25升高
E. 具有男性化作用

正确答案：B。有恶性程度的逆转倾向

解析：卵巢未成熟畸胎瘤属恶性肿瘤（A错），其复发后再次手术可见到未成熟肿瘤组织向成熟转化，即恶性程度逆转现象（B对）。hCG升高（C错）提示早期妊娠或滋养细胞肿瘤如葡萄胎、恶性葡萄胎、绒毛膜上皮癌及睾丸畸胎瘤，还对非妊娠性卵巢绒癌有特异性。血清CA125升高（D错）主要见于卵巢上皮性肿瘤。具有男性化作用（E错）的是支持细胞-间质细胞肿瘤，又称睾丸母细胞瘤。